药品不良反应报告制度的目的有
A. 为了保障患者用药安全
B. 为防止历史上药害事件的重演
C. 为评价、整顿、淘汰药品提供服务和依据
D. 为临床用药提供信息
E. 为了作为诉讼的依据

正确答案：A、B、C、D。为了保障患者用药安全；为防止历史上药害事件的重演；为评价、整顿、淘汰药品提供服务和依据；为临床用药提供信息